女性，42岁。两侧后牙咬硬物时酸痛。口腔检查：两侧上下后（牙合）面磨损严重，探诊酸痛，温度刺激试验酸痛，不松动，牙周检查（-）。可能的诊断是
A. 磨损
B. 浅龋
C. 楔状缺损
D. 逆行性牙髓炎
E. 牙周萎缩，牙根外露

正确答案：A。磨损

解析：本题考查磨损。女性，42岁。两侧后牙咬硬物时酸痛。口腔检查：两侧上下后（牙合）面磨损严重，探诊酸痛，温度刺激试验酸痛，不松动，牙周检查（-）。可能的诊断是磨损（A对）。牙本质敏感对机械和温度刺激敏感，表现为探诊酸痛，温度刺激酸痛；常见的危险因素有磨损、龋病、楔状缺损、牙折以及牙周萎缩所致的牙颈部暴露等。患者口腔检查：两侧上下后（牙合）面磨损严重，探诊酸痛，温度刺激试验酸痛，患者出现牙本质敏感的原因可能是磨损导致的牙本质暴露。浅龋一般无主观症状，遭受外界的物理和化学刺激亦无明显反应（B错）。楔状缺损是发生在牙齿唇、颊面颈部的缺损（C错）。逆行性牙髓炎的患牙有深达根尖区的牙周袋或较为严重的根分叉病变，牙龈水肿、充血、牙周袋溢脓，患牙有不同程度的松动（D错）。该患者牙周检查（-），无牙周萎缩及牙根外露的情况（E错）。